治疗急性心肌梗死气阴亏损，心络瘀阻证，应首选
A. 生脉散合温胆汤
B. 生脉散合瓜蒌薤白半夏汤
C. 保元汤合血府逐瘀汤
D. 参附汤合血府逐瘀汤
E. 生脉散合血府逐瘀汤

正确答案：E。生脉散合血府逐瘀汤

解析：急性心肌梗死气阴亏损，心络瘀阻证，治法为益气养阴，理气活血，通脉止痛，生脉散可以益气养阴复脉，血府逐瘀汤可以活血化瘀，止痛，生脉散合血府逐瘀汤为首选（E对）。